龋病病因现代概念正确的是
A. 有致龋菌存在就一定患龋
B. 有蔗糖存在就一定患龋
C. 有宿主因素存在就一定患龋
D. 有致龋菌和蔗糖存在就一定患龋
E. 有致龋菌、蔗糖、宿主因素存在，在一定时间内可患龋病

正确答案：E。有致龋菌、蔗糖、宿主因素存在，在一定时间内可患龋病

解析：本题考查龋病的四联因素学说。龋病病因现代概念是指龋病四联因素理论：有致龋菌、蔗糖、宿主因素存在，在一定时间内可患龋病（E对）。细菌的存在是龋病发生的先决条件；食糖消耗水平与龋病发生呈正相关关系，细菌可以利用糖通过糖酵解过程为其提供能量同时产生各种酸，导致牙齿脱矿，发生龋病；宿主因素是指龋病的易感程度，宿主对龋病的敏感性涉及多方面因素，如唾液的流速、流量、牙的形态与结构等；龋病发病的每一个过程都需要一定的时间才能完成。龋病的发生是以上四种因素综合作用的结果，所以有致龋菌存在就一定患龋（A错）、有蔗糖存在就一定患龋（B错）或有宿主因素存在就一定患龋（C错）的说法是不准确的，有致龋菌和蔗糖存在就一定患龋（D错）的说法也是不准确的。